参松养心胶囊除活血通络外，还可
A. 理气
B. 凉血
C. 散瘀止血
D. 益气养阴
E. 补气活血

正确答案：D。益气养阴

解析：本题考查的是参松养心胶囊的功能。参松养心胶囊除活血通络外，还可益气养阴（D对）。参松养心胶囊：【功能】益气养阴，活血通络，清心安神。元胡止痛片：【功能】理气（A错），活血，止痛。槐角丸：【功能】清肠疏风，凉血（B错）止血。三七片：【功能】散瘀止血（C错），消肿止痛。消栓胶囊：【功能】补气活血（E错）通络。